五味理论认为，大多能伤津、伐胃，津液大伤及脾胃虚弱者不宜大量使用的是
A. 甘味药
B. 苦味药
C. 咸味药
D. 涩味药
E. 淡味药

正确答案：B。苦味药

解析：本题考查的是苦味药的效用及临床应用。五味理论认为，大多能伤津、伐胃，津液大伤及脾胃虚弱者不宜大量使用的是苦味药（B对）。苦味药大多能伤津、伐胃，津液大伤及脾胃虚弱者不宜大量用。甘味药（A错）大多能腻膈碍胃，令人中满，凡湿阻、食积、中满气滞者慎用。咸味药（C错）不宜多食，高血压动脉硬化者尤当如此。有的咸味药如芒硝，能泻下通肠，脾虚便溏者慎用。涩味药（D错）大多能敛邪，邪气未尽者慎用。淡味药（E错）过用，亦能伤津液，阴虚津亏者慎用。